男，18岁。右大腿下端肿胀，疼痛伴消瘦乏力2个月。查体：右膝上肿胀，皮肤静脉怒张。X线片见右股骨下端骨质破坏，可见Codman三角。最佳治疗方案应选择：
A. 刮除骨植
B. 抗结核治疗
C. 术前化疗加保肢术
D. 抗感染治疗
E. 消肿镇痛治疗

正确答案：C。术前化疗加保肢术

解析：青少年男性患者，右大腿下端肿胀、疼痛伴消瘦乏力、皮肤静脉怒张（骨肉瘤常见表现），X线片见右股骨下端骨质破坏、Codman三角（骨肉瘤典型影像学表现），结合患者症状、体征和影像学表现，该患者最可能的诊断为右股骨下端骨肉瘤。骨肉瘤为恶性骨肿瘤，故应采用根治性切除瘤段、植入假体的保肢手术或截肢手术。由于骨肉瘤对化疗敏感，故术前术后均应行化学治疗（C对）。刮除植骨（A错）主要适用于良性骨肿瘤及瘤样病变。骨肉瘤为恶性骨肿瘤，不是感染性疾病，所以抗结核治疗（B错）、抗感染治疗（D错）、消炎镇痛治疗（E错）均无效。